国家药物政策的目的不包括
A. 基本药物的可获得性
B. 保证向公众提供安全、有效的药品
C. 保证向公众提供质量合格的药品
D. 保证向公众提供廉价的药品
E. 合理用药

正确答案：D。保证向公众提供廉价的药品

解析：本题考查的是实施基本药物制度的目标。国家药物政策的目的不包括保证向公众提供廉价的药品（D错，为本题正确答案）。实施基本药物制度的目标：我国幅员辽阔，城乡、地区发展差异大，在全国范围内建立实施基本药物制度的目标主要包括：①提高群众获得基本药物的可及性（A对），保证群众基本用药需求；②维护群众的基本医疗卫生权益，促进社会公平正义；③改变医疗机构“以药补医”的运行机制，体现基本医疗卫生的公益性；④规范药品生产流通使用行为，促进合理用药（E对），减轻群众负担。完善国家基本药物制度，重点强化基本药物“突出基本、防治必需、保障供应、优先使用、保证质量、降低负担”的功能定位（C对），从基本药物的遴选、生产、流通、使用、支付、监测等环节完善政策，全面带动药品供应保障体系建设，着力保障药品安全有效（B对）、价格合理、供应充分，缓解“看病贵”问题。